女，14岁。月经初潮后1年，月经期1～4个月，经量多，伴血块。止血首先应选择
A. 大剂量雌激素
B. 雄激素
C. 孕激素
D. 雌孕激素联合法
E. 刮宫术

正确答案：D。雌孕激素联合法

解析：患者为青春期女性（无排卵性功血好发于青春期和绝经过渡期），月经初潮后1年，月经期1～4个月，经量多，伴血块（做常见的症状是子宫不规则出血，表现为月经周期紊乱），应首先考虑为青春期无排卵性功血。这是由于在青春期，下丘脑-垂体-卵巢轴激素间的反馈调节尚未成熟，导致雌激素水平低，子宫内膜修复能力差而引起出血，故止血首选雌孕激素联合法（D对）。性激素联合用药的止血效果优于单一用药，在治疗青春期和生育年龄无排卵性功血时常常有效。大剂量雌激素（P348）（A错）可迅速促使子宫内膜生长，短期内修复创面而止血，适用于急性大出血时。雄激素（P348）（B错）中的丙酸睾酮具有对抗雌激素作用，减少盆腔充血和增加子宫血管张力，以减少子宫出血量，但仅仅起协助止血作用。孕激素（P348）（C错）止血机制是使雌激素作用下的持续增生的子宫内膜转化为分泌期，达到止血效果，停药后子宫内膜脱落较完全，起到药物性刮宫作用，适用于体内已有一定雌激素水平的患者。刮宫术（P348）（E错）可迅速止血，适用于绝经过渡期及病程长的生育年龄患者，但对无性生活史青少年，不轻易做刮宫术。